HLA复合体基因不编码
A. HLA-I类分子的重链（α链）
B. HLA-I类分子的轻链（β链）
C. HLA-Ⅱ类分子的O链
D. HLA-Ⅱ类分子的p链
E. B因子

正确答案：B。HLA-I类分子的轻链（β链）

解析：HLA复合体基因编码主要组织相容性复合体，可引起强烈而迅速的排斥反应，包括HLA-I类分子的重链（A对）、HLA-Ⅱ类分子的重链和轻链（CD对）、B因子（E对）。HLA-I类分子的轻链（B错，为本题正确答案）由位于第15号染色体上的β2微球蛋白基因编码。